致畸试验首选的实验动物是
A. 大鼠
B. 小鼠
C. 豚鼠
D. 家兔
E. 狗

正确答案：A。大鼠